传导舌前2/3味觉的神经是
A. 舌咽神经
B. 迷走神经
C. 舌下神经
D. 面神经
E. 舌神经

正确答案：D。面神经

解析：鼓索为面神经（D对）出茎乳孔前发出的分支，返回鼓室，穿岩鼓裂出鼓室，行向前下加入舌神经。鼓索含有味觉纤维和副交感纤维，前者随舌神经分布于舌前2/3的味蕾，后者进入下颌下神经节，更换神经元后控制舌下腺和下颌下腺的分泌。舌咽神经（A错）传导舌后1/3的感觉和味觉。舌下神经（C错）支配舌内肌和大部分舌外肌。